男婴10个月，出生后牛奶喂养，经常出现多汗、烦躁、近一周加重偶有腹泻、呕吐。查体：枕秃，前囟大，方颅。实验室检查：血钙稍低，血磷降低，碱性磷酸酶升高。X线示干骺端临时钙化呈毛刷样。最适合的治疗措施是
A. 维生素D400-800IU/日口服
B. 维生素D2000-4000IU/日口服
C. 补充钙剂
D. 补充磷酸盐
E. 维生素D30万IU肌注

正确答案：B。维生素D2000-4000IU/日口服

解析：婴幼儿，出生后牛奶喂养，经常出现多汗、烦躁、近一周加重偶有腹泻、呕吐（营养性维生素D缺乏的典型症状），查体：枕秃，前囟大，方颅（营养性维生素D缺乏的特征性体征），实验室检查：血钙稍低，血磷降低，碱性磷酸酶升高，X线示干骺端临时钙化呈毛刷样（提示该患儿处于激期），根据患者的症状、体征及实验室检查，考虑最可能的诊断为营养性维生素D缺乏激期，所以最适合的治疗措施为维生素D2000-4000IU/日口服，连服 1个月后，改为 400 - 800IU/d。口服困难或腹泻等影响吸收时，采用大剂量突击疗法，维生素D15万-30万IU（3. 75 -7. 5mg）/次，肌注，1个月后再以400-800IU/d维持（B对AE错），在补充维生素D的同时，可给予适量钙剂（C错）及微量元素（D错）。